急起发热，腹痛，腹泻，脓血便，可能的诊断是
A. 急性菌痢普通型
B. 慢性菌痢急性发作型
C. 中毒型菌痢
D. 急性菌痢轻型
E. 慢性菌痢隐匿型

正确答案：A。急性菌痢普通型

解析：急起发热，腹痛，腹泻，脓血便是急性菌痢普通型的临床表现（A对）。慢性菌痢急性发作型临床表现与急性典型菌痢相似，但病情轻，发热及全身中毒症状不明显。常于半年内有菌痢病史或复发史，而除外同群痢疾杆菌再感染，或异群痢疾杆菌或其他引起腹泻病原体的感染（B错）。中毒型菌痢 2～7 岁儿童多见。起病急骤，畏寒、寒战伴高热，全身中毒症状重，可伴有嗜睡、惊厥、抽搐，迅速出现循环衰竭和呼吸衰竭，而肠道症状不明显或缺如（C错）。急性菌痢轻型（非典型）症状轻，可仅有腹泻、稀便（D错）。慢性菌痢隐匿型一年内有菌痢史，症状消失2个月以上，但粪便培养可检出痢疾杆菌，结肠镜检查可见肠黏膜炎症或溃疡等病变（E错）。